解磷定应用于有机磷农药中毒后，抑制作用最为明显的是
A. 流涎
B. 肌颤
C. 瞳孔缩小
D. 呼吸困难
E. 大便失禁

正确答案：B。肌颤

解析：明显减轻N样症状：对骨骼肌痉挛的抑制作用最为明显，能迅速抑制肌束颤动。掌握“难逆性抗胆碱酯酶药及胆碱酯酶复活药”知识点。